下列哪项不属于体液免疫的效应作用
A. 调理作用
B. ADCC
C. DTH反应
D. 中和作用
E. CDC

正确答案：C。DTH反应